严重贫血时，下述指标变化中哪一项是不存在的
A. 血氧含量↓
B. PaO₂↓
C. A血氧含量↓
D. A血氧饱和度正常
E. V血氧含量减少

正确答案：B。PaO₂↓

解析：严重贫血易引起血液性缺氧，而PaO₂正常（B错，为本题正确答案）、血氧含量降低（ACE对）、血氧容量正常或降低、血氧饱和度正常或降低（D对）、动-静脉血氧含量差降低是血液性缺氧的血氧变化特点。